患者，女，60岁，初戴全口义齿，医师检查发现在正中（牙合）接触时，咬合接触点少若检查发现前伸（牙合）时仅有前牙接触，后牙不接触，应调磨的位置是
A. 下切牙切缘
B. 上切牙切缘
C. 下切牙舌斜面和上切牙舌斜面
D. 下切牙切缘唇斜面和上切牙切缘舌斜面
E. 下切牙切缘和上切牙切缘舌斜面

正确答案：D。下切牙切缘唇斜面和上切牙切缘舌斜面

解析：本题考查全口义齿选磨调牙合的方式。患者初戴全口义齿，正中牙合接触时，咬合接触点少（咬合异常）若检查发现前伸牙合时仅有前牙接触，后牙不接触（前伸牙合前牙牙合干扰），应调磨的位置是下切牙切缘唇斜面和上切牙切缘舌斜面（D对），避免磨短上颌前牙。下切牙切缘（A错）与下切牙切缘和上切牙切缘舌斜面（E错）调磨均易导致垂直距离降低，不符合选磨的要求。上切牙切缘（B错）应避免被磨短。下切牙舌斜面和上切牙舌斜面（C错）非互相接触的斜面，调磨不能改善牙合接触。